男，71岁。间断咳嗽、咳痰20余年，加重伴喘憋1周。近2天出现嗜睡。查体：意识模糊，口唇发绀，球结膜水肿，双肺满布哮鸣音。双下肢水肿。该患者出现意识障碍最主要的机制是
A. 心源性休克
B. 电解质紊乱
C. 肺性脑病
D. 感染中毒性脑病
E. 脑出血

正确答案：C。肺性脑病

解析：71岁老年男性患者，间断咳嗽、咳痰20余年，加重伴喘憋1周（慢性阻塞性肺疾病病史，COPD急性加重期）。近2天出现嗜睡（出现中枢抑制症状）。查体：意识模糊，口唇发绀，球结膜水肿，双肺满布哮鸣（呼吸衰竭，肺性脑病表现）。双下肢水肿。综合患者病史症状、体征及辅助检查结果，考虑诊断为肺性脑病（C对）。该患者出现意识障碍最主要的机制是由于CO2潴留使脑脊液H+浓度增加，影响脑细胞代谢，降低脑细胞兴奋性，抑制皮质活动。心源性休克（A错）是由心脏病变引起全身循环灌注不足引起，该患者原发病为慢性肺阻塞性疾病，故不选。电解质紊乱（B错）是COPD可引起的并发症，不是意识障碍的原因，故排除。感染中毒性脑病（D错）常表现为反应迟钝、意识障碍、震颤、活动困难、生活不能自理和中毒性精神病表现。脑出血（E错）一般无肺疾病表现，可有头疼、意识障碍、偏瘫等症状，排除。